蛲虫病的预防措施不包括
A. 在集体儿童机构开展普查
B. 进行卫生宣教工作
C. 每年预防性口服灭虫药物
D. 培养良好的卫生习惯
E. 集体儿童机构勤用湿扫法打扫

正确答案：C。每年预防性口服灭虫药物

解析：蛲虫病的预防措施包括：注意个人卫生，培养良好的卫生习惯（D对），勤剪指甲，保持双手清洁，纠正吮指等不良习惯；加强卫生宣传（B对），改善环境卫生，切断传播途径；防止重复感染，家庭或集体儿童机构中的患儿应同时治疗，勤换衣物及被褥并用开水浸泡或煮蒸后在阳光下暴晒，以免再感染；居住环境应大扫除，采用湿擦湿扫（E对），防止虫卵飞扬，清洗并蒸煮玩具、用具等（C错，为本题正确答案）。在集体儿童机构开展普查属于流行病学调查，为预防性措施（A对）。